下列关于感染过程的描述，错误的是
A. 病原体与人体相互作用，相互斗争的过程称为感染过程
B. 感染过程的构成必须具备病原体、人体和外环境三个因素
C. 病原体的致病力包括毒力、侵袭力、病原体数量和变异性
D. 病原体侵入的数量越大，出现显性感染的危险也越大
E. 病原体侵入人体，只要发病就意味着感染过程的开始

正确答案：E。病原体侵入人体，只要发病就意味着感染过程的开始

解析：病原体通过各种途径进入人体后意味着感染过程的开始（E错，为本题正确答案），而临床上是否出现症状和体征，是否发病，则取决于病原菌的致病力和机体的免疫功能。感染过程即病原体与人体相互作用，相互斗争的过程（A对）。感染过程由病原体、人体和外环境三个因素构成（B对）。病原体侵入的数量越大，出现显性感染的危险也越大（D对）。病原体的致病力包括毒力、侵袭力、病原体数量和变异性（C对）。